小儿营养中最主要的能量来源是
A. 矿物质
B. 糖类
C. 脂类
D. 膳食纤维
E. 蛋白质

正确答案：B。糖类

解析：人体的宏量营养素有：蛋白质、脂类、碳水化合物。碳水化合物包括糖类，糖类是供能的主要物质（B对）占总能量的55%~65%。蛋白质（E错）的主要功能是构成机体和组织器官的重要成分，次要功能是供能，占总能量的8%~15%。脂类（C错）是机体的第二供能营养素，6个月以下占婴儿总能量的45%~50%。人体的微量营养素：矿物质、维生素。矿物质（A错）不提供能量。其他膳食成分包括膳食纤维和水，膳食纤维（D错）指一般不易被消化的食物营养素，不提供能量。